尿道第二个扩大部位在
A. 尿道前列腺部
B. 尿道膜部
C. 尿道球部
D. 尿道海绵体部
E. 尿道舟状窝

正确答案：C。尿道球部

解析：尿道三个膨大由内向外分别是尿道前列腺部、尿道球部和舟状窝，尿道球部（C对）为尿道第二个扩大部位。